下极又称为
A. 幽门
B. 魄门
C. 阑门
D. 吸门
E. 贲门

正确答案：B。魄门

解析：饮食物的消化吸收和排泄，须通过消化道的七道门户，《难经》称为“七冲门”。《难经·四十四难》：“唇为飞（扉）门，齿为户门，会厌为吸门（D错），胃为贲门（E错），太仓下口为幽门（A错），大肠小肠会为阑门（C错），下极为魄门（B对），故曰七冲门也。”